劳淋治法是
A. 补气益血
B. 补脾益肾
C. 补益肝肾
D. 健脾补肺
E. 补肺益肾

正确答案：B。补脾益肾

解析：劳淋者，遇劳即发，为中气不足，脾气虚弱，无力固摄致小便淋漓不已，治宜健脾。再者腰膝酸软为肾虚，淋漓不尽为肾气虚气化无权所致，又宜补肾（B对）。